关于生物―心理―社会医学模式，下述提法中错误的是
A. 人们关于健康和疾病的基本观点
B. 医学道德进步的重要标志
C. 医学临床活动和医学研究的指导思想
D. 医学实践的反映和理论概括
E. 对医德修养和医德教育的最全面认识

正确答案：E。对医德修养和医德教育的最全面认识

解析：生物―心理―社会医学模式是人们关于健康和疾病的基本观点（A对），是医学临床活动和医学研究的指导思想（C对）、理论框架和行为规范。医学模式来源于医学实践，是对医学实践的反映和理论概括（D对）。生物-心理-社会医学模式是20世纪70年代以后建立起来的一种全新的医学模式。这种医学模式，从生物、心理、社会等综合因素全面认识健康和疾病，而不是对医德修养和医德教育的最全面认识（E错，为本题正确答案）。生物-心理-社会医学模式取代生物医学模式，不仅反映着医学的发展，也是医学道德进步的重要标志（B对）。